新生儿，生后15天，拒乳，反应差2天，黄疸1天，颈部，前胸部可见多个脓疱，皮肤黄染呈中度，肝脏肋下2.5cm，脾脏肋下1.5cm，可诊断为
A. 新生儿颅内出血
B. 新生儿败血症
C. 新生儿核黄疸
D. 感染性肺炎
E. 新生儿寒冷综合征

正确答案：B。新生儿败血症

解析：患者新生儿，生后15天，拒乳，反应差2天，黄疸1天，颈部，前胸部可见多个脓疱，皮肤黄染呈中度，肝脏肋下2.5cm，脾脏肋下1.5cm，结合患者的表现，可诊断为新生儿败血症（B对）。（P103）新生儿颅内出血主要与出血部位和出血量有关：轻者可无症状，大量出血者可在短期内病情恶化而死亡。常见的症状与体征有：①神志改变:激惹、嗜睡或昏迷；②呼吸改变:增快或减慢，不规则或暂停；③颅内压力增高：前囟隆起、血压增高、抽搐、角弓反张、脑性尖叫；④眼征：凝视、斜视、眼球震颤等；⑤瞳孔:不等大或对光反射消失；⑥肌张力：增高、减弱或消失；⑦其他：不明原因的苍白、贫血和黄疸（A错）。 （P111）新生儿黄疸，也称为新生儿高胆红素血症,因胆红素在体内积聚引起的皮肤或其他器官黄染…新生儿血清胆红素超过5～7mg/dl（成人超过2mg/dl）可出现肉眼可见的黄疸.未结合胆红素增高是新生儿黄疸最常见的表现形式，重者可引起胆红素脑病（核黄疸），造成神经系统的永久性损害，甚至死亡（C错）。（p124）感染性肺炎是新生儿期最常见的感染性疾病，也是新生儿死亡的重要病因…可发生在宫内、分娩过程中或生后，由细菌、病毒、原虫及真菌等不同的病原体引起（D错）。。